（牙合）力大小顺序正确的是
A. 第一磨牙﹥第二磨牙﹥第三磨牙﹥第一前磨牙﹥第二前磨牙﹥尖牙﹥中切牙﹥侧切牙
B. 第一磨牙﹥第二磨牙﹥第三磨牙﹥第一前磨牙﹥第二前磨牙﹥尖牙﹥侧切牙﹥中切牙
C. 第一磨牙﹥第二磨牙﹥第三磨牙﹥第一前磨牙﹥尖牙﹥第二前磨牙﹥中切牙﹥侧切牙
D. 第一磨牙﹥第二磨牙﹥第三磨牙﹥第二前磨牙﹥第一前磨牙﹥尖牙﹥中切牙﹥侧切牙
E. 第三磨牙﹥第二磨牙﹥第一磨牙﹥第一前磨牙﹥第二前磨牙﹥尖牙﹥中切牙﹥侧切牙

正确答案：D。第一磨牙﹥第二磨牙﹥第三磨牙﹥第二前磨牙﹥第一前磨牙﹥尖牙﹥中切牙﹥侧切牙

解析：本题考查（牙合）力大小的顺序。（牙合）力大小顺序正确的是第一磨牙﹥第二磨牙﹥第三磨牙﹥第二前磨牙﹥第一前磨牙﹥尖牙﹥中切牙﹥侧切牙（D对）。上下颌牙咬合时，牙周组织所承受之力称为（牙合）力。正常人的（牙合）力平均为22.4～68.3kg。（牙合）力大小顺序为：第一磨牙＞第二磨牙＞第三磨牙＞第二前磨牙＞第一前磨牙＞尖牙＞中切牙＞侧切牙。